下列染色体畸变类型中不计入畸变范围的是
A. 断裂
B. 裂隙
C. 缺失
D. 环状染色体
E. 易位

正确答案：B。裂隙